超高温灭菌的温度范围为
A. 60～95℃
B. 100℃
C. 100～120℃
D. 120～150℃
E. ＞180℃

正确答案：D。120～150℃

解析：本题考查超高温灭菌的温度范围。超高温灭菌的温度范围为120～150℃（D对ABCE错）。